蒙医用药法规定，应从小剂量试服至常用量的有
A. 有毒类药
B. 峻烈类药
C. 过寒性药
D. 过热性药
E. 中性类药

正确答案：A、B、C、D。有毒类药；峻烈类药；过寒性药；过热性药

解析：本题考查的是蒙药的用药剂量。蒙医用药法规定，应从小剂量试服至常用量的有有毒类药（A对）、峻烈类药（B对）、过寒性药（C对）与过热性药（D对）。蒙药的用药剂量：临床用药剂量应根据药物性质、剂型、病情轻重以及患者年龄、性别、体质等情况而定。一般有毒、峻烈、过热或过寒性药，用量宜小，从小剂量试服至常用量；汤剂的用量比丸剂为重，单味药量应比复方为重；轻病用量不必过重，重病则适当增加；老年人、儿童、妇女及体弱者用药剂量宜小。